反应竞争性拮抗药对其受体激动药的拮抗强度的是
A. pD₂
B. pA₂
C. Cmax
D. α
E. tmax

正确答案：B。pA₂

解析：本题考查作用于受体药物的分类。反应竞争性拮抗药对其受体激动药的拮抗强度的是pA₂（B对）。竞争性拮抗药与受体的亲和力可用拮抗参数（pA₂）表示，其含义是：在拮抗药存在时，若2倍浓度的激动药所产生的效应恰好等于未加入拮抗药时激动药的效应，则为所加入拮抗药的摩尔浓度的负对数值。pA₂值的大小反映竞争性拮抗药对其激动药的拮抗强度，药物的pA₂值越大，其拮抗作用越强。pD₂（A错）表示激动药与受体的亲和力。Cmax（C错）表示峰浓度。α（D错）表示内在活性。tmax（E错）表示达峰时间。